上界为颧骨下缘；下界为下颌骨下缘；前界从颧骨下缘至鼻唇沟经口角至下颌下缘的连线；后界浅面相当于咬肌前缘；深面为翼下颌韧带的间隙是
A. 咬肌间隙
B. 眶下间隙
C. 下颌下间隙
D. 颊间隙
E. 颞下间隙

正确答案：D。颊间隙

解析：颊间隙有广义和狭义之分。广义的颊间隙系指位于颊部皮肤与颊黏膜之间、颊肌周围的间隙。其上界为颧骨下缘；下界为下颌骨下缘；前界从颧骨下缘至鼻唇沟经口角至下颌下缘的连线；后界浅面相当于咬肌前缘；深面为翼下颌韧带。掌握“下颌下间隙、颊间隙感染”知识点。